患者男性，50岁，胸闷刺痛，痛有定处，口中黏腻，头晕目眩，心悸气短，面部暗青，舌紫暗苔白腻，脉弦滑。其治法是
A. 益气养阴
B. 豁痰化瘀
C. 通阳泄浊
D. 豁痰理气
E. 祛瘀止痛

正确答案：B。豁痰化瘀

解析：气血运行受阻，不通则痛，故见胸闷刺痛，痛有定处；痰浊中阻故见口中黏腻；痰蒙清窍故见头晕目眩；心阳被遏故见心悸气短；痰瘀内阻故见面部暗青，舌紫暗苔白腻，脉弦滑。患者症状为痰瘀互结证，宜豁痰化瘀（B对）。气阴两虚证宜益气养阴（A错）。痰浊内阻证宜通阳泄浊（C错）。痰浊内阻证宜豁痰理气（D错）。心血瘀阻证宜祛瘀止痛（E错）。